镰状红细胞贫血症患者血红蛋白的基因突变类型
A. 插入
B. 缺失
C. 点突变
D. 双链断裂
E. 倒位或转位

正确答案：C。点突变

解析：镰状红细胞贫血是一种常见的隐性遗传Hb病，因密码子中的GAA发生点突变（C对），变成GTA，β-肽链第6位氨基酸谷氨酸被缬氨酸所代替，导致了镰状红细胞贫血。